需要“严格管理”的传染病疾病是
A. 鼠疫
B. 霍乱
C. 巨细胞病毒
D. 艾滋病
E. 麻风

正确答案：D。艾滋病

解析：鼠疫（A错）、霍乱（B错）为甲类传染病，属于强制管理的烈性传染病，要求发现后2小时内通过传染病疫清监测信息系统上报；麻风（E错）为丙类传染病，属于监测管理传染病，采取乙类传染病的报告、控制措施；巨细胞病毒（C错）属于庖疹病毒科，在人群中感染广泛，目前还没有疫苗上市。